妇科十味片具有养血舒肝、调经止痛的功能。处方组成：醋香附500g、川芎20g、当归180g、醋延胡索40g、白术29g、甘草14g、大枣100g、白芍15g、赤芍15g、熟地黄60g、碳酸钙65g。以上十一味，当归126g、醋香附、醋延胡索、白芍、赤芍、碳酸钙粉碎成细粉，甘草、大枣加水煎煮三次，合并煎液，滤过；剩余当归与白术、熟地黄、川芎用70%乙醇加热回流二次，滤过，合并二次滤液，回收乙醇。将以上两种滤液合并，减压浓缩为稠膏，加入上述醋香附等六味细粉，混匀，干燥，粉碎成细粉，用糖浆与淀粉糊制成颗粒，干燥压制成3000片，包薄膜衣，即得。处方中当归的鉴别特征是
A. 草酸钙针晶细不规则地充塞于薄壁细胞中
B. 纤维成束，周围薄壁细胞含草酸钙方晶，形成晶纤维
C. 韧皮薄壁细胞纺锤形，壁略厚，表面有极微细的斜向交错纹理
D. 薄壁组织灰棕色至黑棕色，细胞多皱缩，内含棕色核状物
E. 草酸钙簇晶存在于薄壁细胞中，常排列成行或一个细胞中含数个簇晶

正确答案：C。韧皮薄壁细胞纺锤形，壁略厚，表面有极微细的斜向交错纹理

解析：本题考查当归的显微鉴别。当归的显微鉴别特征是韧皮薄壁细胞纺锤形，壁略厚，表面有极微细的斜向交错纹理（C对）。当归【显微鉴别】粉末当归、酒当归：韧皮薄壁细胞纺锤形，壁略厚，表面有极微细的斜向交错纹理。有时可见菲薄的横隔。梯纹导管和网纹导管多见。有时可见油室碎片。白术【显微鉴别】粉末白术、麸炒白术：草酸钙针晶细小，长10～32㎛，不规则地充塞于薄壁细胞中（A错）。纤维长梭形，大多成束，壁甚厚，木化，孔沟明显。石细胞淡黄色，类圆形、多角形、长方形或少数纺锤形。薄壁细胞含菊糖，表面显放射状纹理。甘草【显微鉴别】粉末甘草、甘草片、炙甘草：纤维成束，直径8～14㎛，壁厚，微木化，周围薄壁细胞含草酸钙方晶（B错），形成晶纤维。草酸钙方晶多见。木栓细胞红棕色，多角形，微木化。具缘纹孔导管较大。地黄【显微鉴别】粉末生地黄、熟地黄：薄壁组织灰棕色至黑棕色，细胞多皱缩，内含棕色核状物（D错）。分泌细胞形状与一般薄壁细胞相似，内含橙黄色或橙红色油滴状物。具缘纹孔导管和网纹导管，直径约至92㎛。白芍【显微鉴别】粉末白芍、炒白芍、酒白芍：糊化淀粉粒团块甚多。草酸钙簇晶直径11～35㎛，存在于薄壁细胞中，常排列成行或一个细胞中含数个簇晶（E错）。纤维长梭形，直径15～40㎛，壁厚，微木化，具大的圆形纹孔。